对G+菌作用略逊于第一代头孢，且对于铜绿假单胞菌无效的抗生素是
A. 第一代头孢菌
B. 第二代头孢菌
C. 第三代头孢菌
D. 青霉素类
E. 红霉素

正确答案：B。第二代头孢菌

解析：第二代头孢菌素对G+菌作用略逊于第一代，对G-菌有明显作用，对厌氧菌有一定作用，但对铜绿假单胞菌无效。对多种β-内酰胺酶比较稳定。可用于治疗敏感菌所致肺炎、胆道感染、菌血症、尿路感染和其他组织器官感染等。掌握“青霉素及头孢菌素类药”知识点。